哮喘急性发作首选的药物是
A. 沙丁胺醇气雾剂
B. 孟鲁司特片
C. 布地奈德福莫特罗吸入剂
D. 羧甲司坦口服液
E. 氨茶碱片

正确答案：A。沙丁胺醇气雾剂

解析：本题考查哮喘相关用药特点。哮喘急性发作首选的药物是沙丁胺醇气雾剂（A对）。控制哮喘急性发作首选药：β₂受体激动剂。短效β₂受体激动剂：沙丁胺醇和特布他林。长效β₂受体激动剂：福莫特罗、沙美特罗、丙卡特罗。孟鲁司特（B错）用于成人及儿童哮喘的预防和长期治疗，也可用于减轻过敏性鼻炎引起的症状。布地奈德福莫特罗吸入剂（C错）不用于哮喘初始治疗，在使用时需根据病情调整剂量到能有效控制哮喘症状的最小剂量。羧甲司坦（D错）用于慢性支气管炎、支气管哮喘等引起的痰液粘稠、咳出困难者。氨茶碱片（E错）适用于支气管哮喘、喘息型支气管炎、阻塞性肺气肿等缓解喘息症状，也可用于心源性肺水肿引起的哮喘。